药物漱口制剂中没有
A. 氯己定
B. 抗生素
C. 血根碱
D. 酚类化合物
E. 季铵化合物

正确答案：B。抗生素

解析：在机械性控制菌斑的基础上，配合化学制剂可有效地控制菌斑，达到预防和治疗牙周病的目的。常用控制菌斑的化学制剂有以下几类：①氯己定；②酚类化合物（又称香精油）；③季铵化合物；④血根碱；⑤氟化亚锡；⑥三氯羟苯醚。掌握“菌斑控制及提高宿主抵抗力”知识点。